女孩，2岁，高热四天，温度39.0～39.8度，使用青霉素治疗无效。查体：身上多形性红斑，手足指端硬性水肿，双眼球结膜充血，颈部淋巴结肿大，口咽部黏膜弥漫性充血，口唇干裂，舌乳头轮廓突出，血常规：WBC14×10⁹/L，N：0.84，L：0.2，血小板200×10⁹/L。选用什么药物治疗
A. 青霉素
B. 伐昔洛韦
C. 利巴韦林
D. 丙种球蛋白
E. 糖皮质激素

正确答案：D。丙种球蛋白

解析：女孩高热四天，温度39.0～39.8度，使用青霉素治疗无效（免疫学疾病），查体：身上多形性红斑，手足指端硬性水肿（川崎病特征性表现），双眼球结膜充血，颈部淋巴结肿大，口咽部黏膜弥漫性充血，口唇干裂，舌乳头轮廓突出，符合川崎病诊断，静脉注射免疫球蛋白（IVIG）宜于发病早期（10天以内）应用，可迅速退热，预防冠状动脉病变发生（D对）。糖皮质激素不可以单用（E错）。青霉素抗细菌感染（A错），伐昔洛韦、利巴韦林抗病毒（BC错）。